目前中药定性使用最多的色谱是
A. 柱色谱
B. 薄层色谱法
C. 气相色谱法
D. 高效液相色谱法
E. 纸色谱

正确答案：B。薄层色谱法

解析：本题考查的是薄层色谱法的概念。目前中药定性使用最多的色谱是薄层色谱法（B对）。薄层色谱法系将供试品溶液点于薄层板上，在展开容器内用展开剂展开，使供试品所含成分分离，所得色谱图与适宜的对照物（对照品或对照药材）按同法所得的色谱图对比，并可用薄层扫描仪进行扫描，用于鉴别、检查或含量测定。薄层色谱法因其快速、简便和灵敏，是目前中药鉴定中用于定性鉴别使用最多的色谱法之一。柱色谱（A错）可分为分配柱色谱和吸附柱色谱两种原理。将两相溶剂中的一相涂覆在硅胶等多孔载体上，作为固定相，填充在色谱管中，然后加入与固定相不相混溶的另一相溶剂（流动相）冲洗色谱柱。气相色谱法（C错）也是判断物质纯度的一种重要方法，但只适用于在高真空和一定加热条件下能够气化而不被分解的物质。高效液相色谱法（D错）系采用高压输液泵将规定的流动相泵入装有填充剂的色谱柱进行分离测定的色谱方法。纸色谱（E错）法实质上也是液液萃取法的原理，只是两相中其中一相以固态为基质，与某种液相形成饱和状态，进而达到分离的目的。